车前子的主治病证不包括
A. 口舌生疮
B. 湿热淋痛
C. 暑湿水泻
D. 肝热目赤
E. 肺热咳嗽

正确答案：A。口舌生疮

解析：本题考查车前子的主治病证。车前子的主治病证不包括口舌生疮（A错，为本题正确答案）。车前子【主治病证】（1）湿热淋证（B对），小便不利，水肿兼热。（2）暑湿水泻（C对）。（3）肝热目赤（D对）肿痛，肝肾亏虚之目暗不明（配补肝肾药）。（4）肺热咳嗽（E对）痰多。